意识障碍伴瞳孔缩小，可见于
A. 阿托品中毒
B. 酒精中毒
C. 有机磷农药中毒
D. 癫痫
E. 肝昏迷

正确答案：C。有机磷农药中毒

解析：意识障碍伴瞳孔缩小，可见于吗啡类、巴比妥类、有机磷杀虫药等中毒（C对）。阿托品中毒（A错）、酒精中毒（B错）、癫痫（D错）、肝昏迷（E错）表现为意识障碍伴瞳孔散大。